下列有关自然杀伤T细胞说法正确的是
A. 又称NKT
B. 仅有T细胞的T淋巴细胞
C. 又称为CD1限制性B细胞
D. NKT约占外周血T细胞的0.2%
E. NKT表达αβTCR和多种T细胞的表面标志

正确答案：A。又称NKT

解析：自然杀伤T细胞（NKT）是兼有T细胞和NK细胞性质的T淋巴细胞，因其识别非多态性的CD1d分子，也被称为CD1限制性T细胞。CD1分子是结合外来或自身脂类和糖脂的抗原提呈分子。NKT约占外周血T细胞的0.1%。NKT表达αβTCR和多种NK细胞的表面标志，如CD16和CD56，表达颗粒酶。掌握“T淋巴细胞”知识点。